甲状腺切除术术后拆线的时间
A. 4～5天
B. 6～7天
C. 7～9天
D. 10～12天
E. 14天

正确答案：A。4～5天

解析：缝线的拆除时间：一般头、面、颈部手术后4～5天拆线，下腹部、会阴部在术后6～7天拆线，胸部、上腹部、背部、臀部手术7～9天拆线，四肢手术10～12天拆线，减张缝合14天拆线。甲状腺切除术切口位于颈部，故其拆线时间应为术后4～5天（A对）。